女，28岁，主诉：下前牙舌侧牙龈长一肿瘤3个月，并慢慢增大，影响进食。该患者如果诊断为妊娠瘤，需切除时，应注意以下因素，除外
A. 牙龈炎症
B. 妊娠的时间
C. 妊娠期是否服药
D. 口腔卫生情况
E. 手术方法的选择（激光等）

正确答案：C。妊娠期是否服药

解析：本题考查妊娠瘤的治疗。该患者如果诊断为妊娠瘤，需切除时，应注意以下因素，除外妊娠期是否服药（C错，为本题的正确答案）。妊娠瘤的治疗治疗原则与慢性龈炎相似，对一些体积较大的妊娠期龈瘤（A对），若已妨碍进食，则可在彻底清除局部刺激因素后考虑手术切除。手术时机应尽量选择在妊娠期的4～6个月内（B对），以免引起流产或早产。术中应避免流血过多，术后应严格控制菌斑（D对），以防复发。